患者的依从性是指患者
A. 执行医嘱率
B. 从众行为概率
C. 接受暗示程度
D. 对医生的信任程度
E. 患者出现意识障碍

正确答案：A。执行医嘱率